正确描述膝关节的是
A. 由股骨下端和腓骨上端构成
B. 腓侧副韧带与关节囊愈着
C. 胫侧副韧带与关节囊愈着
D. 外侧半月板较大，呈C”形
E. 内侧半月板较大，呈“O”形

正确答案：C。胫侧副韧带与关节囊愈着

解析：膝关节由股骨下端、胫骨上端和髌骨构成（A错）。关节囊那个周围有许多韧带加强，其中，胫侧副韧带与关节囊（C对B错）和两侧半月板愈着。外侧半月板较小呈O型（D错），内侧半月板较大，呈C型（E错）。